内源性凝血系统的激活是
A. 凝血因子Ⅻ与胶原、内毒素接触后被激活
B. 凝血因子Ⅻ被激肽释放酶等水解而激活
C. 两者都是
D. 两者都不是
E. 无

正确答案：C。两者都是

解析：内源性凝血系统的激活是凝血因子Ⅻ与胶原、内毒素接触后被激活和凝血因子Ⅻ被激肽释放酶等水解而激活（A）。内源性凝血系统是从FXII的激活开始的，凝血因子Ⅻ与胶原、内毒素接触后被激活（A对），FXII被激活为FXIla,接着再激活FXI为FXla,从而启动内源性凝血途径。凝血因子Ⅻ被激肽释放酶等水解而激活（B对，C为本题正确答案）。